计算结果会受选用参数个数影响的是
A. 比值简单叠加型大气质量指数
B. 兼顾最高分指数和平均分指数的大气质量指数
C. 分段线型函数型大气质量指数
D. 水质评分加权型指数
E. 比值算术平均型大气质量指数

正确答案：A。比值简单叠加型大气质量指数